女性，28岁，主诉：半年来全口牙龈逐渐肿大，刷牙出血。收集病史时，对鉴别诊断有意义的项目如下，除外
A. 家族史
B. 吸烟史
C. 全身状况
D. 服药史
E. 妊娠史

正确答案：B。吸烟史

解析：有牙龈肥大表现的疾病包括药物性牙龈增生、妊娠期龈炎、遗传性纤维瘤病、全身病在牙龈的表现如白血病等，因此相关的病史对鉴别很重要，吸烟是牙周疾病的危险因素，应注意询问，但在此对鉴别诊断的意义不大。掌握“妊娠期龈炎”知识点。